风湿马钱片具有祛风除湿、活血祛瘀、通络止痛的作用，用于风湿闭阻、瘀血阻络所致的痹病。处方组成：马钱子粉125g、炒僵蚕19g、乳香（炒）19g、没药（炒）19g、全蝎19g、牛膝19g、苍术19g、麻黄19g、甘草19g。制法：以上九味全蝎、乳香、没药和炒僵蚕粉碎成细粉：麻黄、苍术分别用70%乙醇作溶剂进行渗漉，收集漉液约180ml回收乙醇浓缩成稠膏；甘草和牛膝加水煎煮三次煎液滤过滤液合并浓缩成稠膏，与上述稠膏合并，加入马钱子粉及全蝎等四味药的细粉，混匀制成颗粒，干燥压制成1000片包糖衣即得。方中主要含有蜕皮激素类化合物的中药是
A. 苍术
B. 乳香（炒）
C. 牛膝
D. 麻黄
E. 甘草

正确答案：C。牛膝

解析：本题考查的是牛膝的化学成分。方中主要含有蜕皮激素类化合物的中药是牛膝（C对）。牛膝含有甾体化合物，包括蜕皮激素和植物甾醇等，蜕皮激素主要为羟基促蜕皮甾酮和牛膝甾酮。《中国药典》以β-蜕皮甾酮为指标成分进行含量测定，要求其含量不得少于0.030%。苍术（A错）主含挥发油，其中主要成分为苍术酮、苍术素、茅术醇及β-桉油醇等。乳香（炒）（B错）为油胶树脂类，主成分为树脂、挥发油和树胶。麻黄（D错）中含有多种生物碱，以麻黄碱和伪麻黄碱为主，前者占总生物碱的40%～90%，《中国药典》以盐酸麻黄碱和盐酸伪麻黄碱为指标成分进行含量测定，要求药材和饮片含盐酸麻黄碱和盐酸伪麻黄碱的总量不得少于0.80%。此外麻黄还含少量的甲基麻黄碱、甲基伪麻黄碱和去甲基麻黄碱、去甲基伪麻黄碱。甘草（E错）所含的三萜皂苷以甘草皂苷含量最高。甘草皂苷又称甘草酸，为甘草中的甜味成分。《中国药典》以甘草苷和甘草酸为指标成分，控制甘草和炙甘草的质量，其中甘草苷为黄酮苷，并要求甘草和炙甘草的甘草苷含量均不得少于0.50%，甘草中甘草酸的含量不得少于2.0%，炙甘草中甘草酸的含量不得少于1.0%。